下列疾病可以出现凝血时间缩短的是
A. 先天性凝血酶原缺乏症
B. 纤维蛋白原缺乏症
C. DIC早期
D. 血小板减少性紫癜
E. 严重肝病

正确答案：C。DIC早期

解析：凝血时间主要反映内源凝血系统的凝血过程，DIC早期（C对）为高凝期，可出现凝血时间缩短。先天性凝血酶原缺乏症（A错）、纤维蛋白原缺乏症（B错）主要表现为APTT、PT以及凝血时间延长。血小板减少性紫癜（D错）主要表现为出血时间延长，凝血时间一般不受影响。严重肝病（E错）时可出现多种凝血因子缺乏，表现为凝血时间延长。